基质熔点不同，软膏制备多采用
A. 浸渍法
B. 乳化法
C. 溶解法
D. 热熔法
E. 渗漉法

正确答案：D。热熔法

解析：本题考查软膏的制备方法。基质熔点不同，软膏制备多采用热熔法（D对）。若软膏基质熔点不同，在常温下不能与药物均匀混合，或药物能在基质中溶解，或药材须用基质加热浸取其有效成分，多采用熔融法。浸渍法（A错）可用来制备酒剂。内服酒剂应以谷类酒为溶剂，可用浸渍法、渗漉法或其他适宜方法制备。酊剂系指原料药物用规定浓度的乙醇提取或溶解（C错）而制成的澄清液体制剂，亦可用流浸膏稀释制成。可供内服或外用。流浸膏剂用渗漉法（E错）制备，也可用浸膏剂稀释而成。浸膏剂用煎煮法、回流法或渗漉法制备。全部提取液应低温浓缩至稠膏状，加稀释剂或继续浓缩至规定的量。制备方法为乳化法（B错）的制剂，2022年考试指南未明确说明。